根据2015年1月发布的《药品经营质量管理规范》，在人工作业的库房储存药品按质量状态实行色标管理，待确定药品为
A. 红色
B. 橙色
C. 黄色
D. 蓝色
E. 绿色

正确答案：C。黄色

解析：本题考查的是药品批发企业药品储存要求。根据2013年1月发布的《药品经营质量管理规范》，在人工作业的库房储存药品按质量状态实行色标管理，待确定药品为黄色（C对）。药品批发企业药品储存要求：企业应当根据药品的质量特性对药品进行合理储存，并符合以下要求：按包装标示的温度要求储存药品，包装上没有标示具体温度的，按照《中华人民共和国药典》规定的贮藏要求进行储存；储存药品相对湿度（RH）为35%～75%；在人工作业的库房储存药品，按质量状态实行色标管理：合格药品为绿色（E错），不合格药品为红色（A错），待确定药品为黄色；储存药品应当按照要求采取避光、遮光、通风、防潮、防虫、防鼠等措施；搬运和堆码药品应当严格按照外包装标示要求规范操作，堆码高度符合包装图示要求，避免损坏药品包装；药品按批号堆码，不同批号的药品不得混跺，跺间距不小于5厘米，与库房内墙、顶、温度调控设备及管道等设施间距不小于30厘米，与地面间距不小于10厘米；药品与非药品、外用药与其他药品分开存放，中药材和中药饮片分库存放；特殊管理的药品应当按照国家有关规定储存；拆除外包装的零货药品应当集中存放；储存药品的货架、托盘等设施设备应当保持清洁，无破损和杂物堆放；未经批准的人员不得进入储存作业区，储存作业区内的人员不得有影响药品质量和安全的行为；药品储存作业区内不得存放与储存管理无关的物品。